酶的催化高效性是因为酶
A. 启动热力学不能发生的反应
B. 能降低反应的活化能
C. 能升高反应的活化能
D. 可改变反应的平衡点
E. 对作用物（底物）的选择性

正确答案：B。能降低反应的活化能